在临床治疗药物监测中血浆样品常用的处理方法有
A. 沉淀蛋白
B. 液-液萃取
C. 固相萃取
D. 炽灼残渣
E. 干燥失重

正确答案：A、B、C。沉淀蛋白；液-液萃取；固相萃取

解析：本题考查常用体内样品处理方法。体内样品的处理方法中，蛋白沉淀法、缀合物水解法、液-液萃取法、固相萃取法、化学衍生化法都是常用的方法。其中最常用的是蛋白沉淀法（A对）、液-液萃取法（B对）、固相萃取法（C对）。